下列关于HEV的相关叙述中，不正确的是
A. 基因组为线状单股正链RNA
B. 有8个基因型
C. 主要经粪-口途径传播
D. 临床表现与甲型肝炎相似
E. 患者多为儿童，病死率较低

正确答案：E。患者多为儿童，病死率较低

解析：甲型肝炎高发于儿童，而戊型肝炎在15～39岁的青年和成人高发。戊型肝炎亦为自限性疾病，多数患者于发病后6～8周康复。但其引起重症肝炎较多，病死率高达1%～3%，约10倍于甲型肝炎，尤其是妊娠6～9个月的孕妇患戊型肝炎易导致流产和急性重型肝炎，病死率高达15%～20%。掌握“丙型、丁型、戊型肝炎病毒”知识点。